传递视觉冲动无关的结构
A. 视网膜双极细胞
B. 内侧膝状体
C. 视网膜节细胞
D. 内囊枕部
E. 距状沟裂

正确答案：B。内侧膝状体

解析：视觉传导通路由三级神经元组成。第一级神经元为视网膜内的双极细胞（A对）。第二级神经元为视网膜内的节细胞（C对），由节细胞发出的轴突形成视神经，经视神经管进入颅腔。在视交叉处，来自两眼视网膜颞侧半的纤维左右交叉，两眼鼻侧半交叉后的纤维和颞侧半不交叉的纤维形成左、右视束，止于第三级神经元即外侧膝状体（B错，为本题正确答案）。然后发出纤维组成视辐射，经内囊后肢（D对）投射至距状沟（E对）周围皮质。